复发性口腔溃疡治疗措施中哪项效果最佳
A. 口腔局部消炎、止痛、促愈合
B. 手术切除
C. 注射转移因子或口服左旋咪唑
D. 尽可能找出与发病有关的全身和局部因素，加以治疗
E. 补充营养

正确答案：D。尽可能找出与发病有关的全身和局部因素，加以治疗

解析：本题考查复发性口腔溃疡的治疗措施。复发性口腔溃疡（RAU）又称复发性阿弗他溃疡，是最常见的口腔黏膜溃疡类疾病，具有周期性、复发性及自限性，其治疗原则是：1、积极寻找RAU发生的相关诱因并加以控制，即尽可能找出与发病有关的全身和局部因素，加以治疗（D对），控制引发RAU的病因可以有效的阻止RAU的发生，是复发性口腔溃疡的最佳治疗方案。2、优先选择局部治疗。3、加强心理疏导，缓解紧张情绪。治疗方法包括药物治疗，物理治疗及心理治疗，其中药物治疗包括局部用药和全身用药。局部用药的目的是消炎止痛、促进愈合。全身用药，包括糖皮质激素、免疫抑制剂、免疫增强剂包括注射转移因子或口服左旋咪唑等。此外，还可以进行其他治疗药物，如补充营养等。虽然口腔局部消炎、止痛、促愈合（A错）、注射转移因子或口服左旋咪唑（C错）、补充营养（E错）也可治疗复发性口腔溃疡，但均为治疗方法，不是最佳选项，而手术切除（B错）会扩大创口面积。